合成前列腺素的前体是
A. 软脂酸
B. 硬脂酸
C. 花生四烯酸
D. 油酸
E. 亚油酸

正确答案：C。花生四烯酸